消化性溃疡患者胃酸分泌增多，为减少患者胃酸，下列哪种治疗无效
A. M受体阻断剂
B. H₁受体阻断剂
C. 高位迷走神经切断
D. 促胃液素受体的阻断剂
E. H⁺-K⁺-ATP酶（质子泵）抑制剂

正确答案：B。H₁受体阻断剂